龋病预防方法中属于菌斑控制的方法是
A. 化学方法
B. 机械方法
C. 生物方法
D. 植物提取物
E. 以上说法均正确

正确答案：E。以上说法均正确

解析：菌斑控制：机械方法；化学方法；其他分法；①植物提取物；②生物方法；③抗菌斑附着剂；④替代疗法；⑤免疫方法。掌握“龋病三级预防”知识点。